患儿，男性，8月，舌系带溃烂1月，查下颌乳中切牙萌出，舌系带两侧可见1.0厘米×0.8厘米大小的溃疡，溃疡增生，边缘高起外翻，有灰白色伪膜。触诊较硬。此患儿可能诊断为
A. 李-弗氏病
B. 贝氏口疮
C. 腺周口疮
D. 褥疮性溃疡
E. 鹅口疮

正确答案：A。李-弗氏病

解析：本题考查创伤性溃疡。Riga-fede ulcer（A对）专指发生于婴幼儿舌腹的溃疡，因过短的舌系带和过锐的新萌中切牙长期摩擦引起，舌系带处充血、肿胀、溃疡。久不治疗则转变为肉芽肿性溃疡，扪诊有坚韧感，影响舌活动。Bednar溃疡由婴儿吮吸拇指或过硬的橡皮奶头引起，固定发生于硬腭、双侧翼沟处黏膜表面，双侧呈对称性分布，浅表溃疡（B错）。腺周口疮溃疡深大，常伴发小溃疡，无创伤史和不良习惯史，口内无机械刺激因素存在（C错）。褥疮性溃疡由持久的非自伤性机械刺激造成，多见于老年人，残根残冠或不良修复体长期损伤黏膜，边缘隆起，色泽灰白，疼痛不明显（D错）。鹅口疮为急性假膜型念珠菌口炎，损害区黏膜充血，有散在的灰白色如雪的柔软小白点，不久即将融合为白色或蓝白色丝绒状斑片（E错）。